长期应用可引起低血钾的降压药是
A. 利舍平
B. 哌唑嗪
C. 硝苯吡啶
D. 氢氯噻嗪
E. 肼苯哒嗉

正确答案：D。氢氯噻嗪

解析：氢氯噻嗪（D对）属于中效利尿药，主要作用于远曲小管近端的Na⁺-Cl⁻同向转运载体，减少Ma⁺、Cl⁻的重吸收，影响肾脏的稀释功能而产生利尿作用，同时对氨酸肝酶也有轻度抑制作用，使H⁺-Na⁺交换减少，Na⁺2-K⁺交换增加，故可引起低血钾。利舍平（A错）主要作用于去甲肾上腺素能神经末梢部位，耗竭其递质NA，阻断外周NA缩血管作用，从而产生降压作用，不良反应较多，较少单独使用，对钾离子无影响。哌唑嗪（B错）可选择性阻断血管平滑肌突触后膜α₁受体，使血管扩张，血压下降，临床用于各型高血压以及慢性心功能不全，主要不良反应为“首剂现象”，不引起低血钾。硝苯吡啶（C错）属于二氢吡啶类钙拮抗药，对血管有较高选择性，可抑制细胞外钙离子内流，减少平滑肌内钙离子浓度，引起小动脉平滑肌舒张，动脉血管扩张，血压降低，无低血钾不良反应。肼苯哒嗉（E错）能直接舒张小动脉平滑，使外周阻力降低，血压下降，可用于中、重度高血压，其降压机制主要是干预血管平滑肌钙离子内流，不引起低血钾。